多生牙最常见的位置
A. 侧切牙区
B. 前磨牙区
C. 下前牙区
D. 上颌恒中切牙之间
E. 磨牙区

正确答案：D。上颌恒中切牙之间

解析：多生牙又叫额外牙，是形成于正常牙列之外的牙，与遗传和发育缺陷有关，在替牙期时的混合牙列及恒牙列多见。多生牙大多数发生在上颌前牙区，有时也见于下颌磨牙区。掌握“迟萌、多生牙和融合牙”知识点。